病毒性心肌炎风热邪毒内侵心脉证的用方是
A. 银翘散
B. 附子汤
C. 葛根芩连汤
D. 生脉散合复脉汤
E. 血府逐瘀汤合生脉散

正确答案：A。银翘散

解析：病毒性心肌炎风热邪毒内侵心脉证是由于风热邪毒由表入里，内舍于心，心脉痹阻所致，治疗时应疏风清热，宁心安神，首选银翘散（A对）。附子汤（B错）其功用为温经助阳，祛寒化湿，适用于肾阳虚衰兼水湿泛滥之证。葛根芩连汤（C错）其功用为解表清里，适用于病毒性心肌炎之湿热侵心证。生脉散合复脉汤（D错），生脉散的功用为益气生津，敛阴止汗，复脉汤的功用为益气滋阴，通阳复脉，二者合用，适用于病毒性心肌炎之气阴亏虚证。血府逐瘀汤合生脉散（E错），血府逐瘀汤的功用为活血化瘀，行气止痛，生脉散的功用为益气生津，敛阴止汗，二者合用，适用于病毒性心肌炎之气虚血滞证。